有害作用的质反应剂量反应关系多呈S形曲线，原因是不同个体的
A. 吸收速度差异
B. 分布部位差异
C. 代谢速度差异
D. 排泄速度差异
E. 易感性差异

正确答案：E。易感性差异